无排卵型功血
A. 经前诊刮子宫内膜分泌不足
B. 经期第5天子宫内膜为混合型
C. 经前诊刮子宫内膜呈增殖期
D. 经前诊刮子宫内膜为分泌期
E. 子宫内膜为蜕膜

正确答案：C。经前诊刮子宫内膜呈增殖期

解析：无排卵性功血患者的子宫内膜受雌激素持续作用而无孕激素拮抗，故经前期不出现分泌期变化，仍然为增生期变化。排卵型功血的子宫内膜是有分泌期变化的。掌握“功能失调性子宫出血”知识点。